纳洛酮临床用于治疗
A. 吗啡中毒
B. 有机磷中毒
C. 心脏骤停
D. 严重腹泻
E. 哮喘急性发作

正确答案：A。吗啡中毒

解析：本题考查纳洛酮。纳洛酮临床用于治疗吗啡中毒（A对）。纳洛酮的临床应用：①首选用于阿片类药物急性中毒；②解除阿片类药物麻醉的术后呼吸抑制及其他中枢抑制症状；③阿片类药物成瘾者的鉴别诊断--肌注可诱发严重戒断症状；④试用于急性酒精中毒、休克、脊髓损伤、中风及脑外伤的救治；⑤研究疼痛与镇痛的工具药。有机磷中毒（B错）用阿托品、氯解磷定、碘解磷定解救。